属于抗雄激素类，可用于晚期前列腺癌治疗的首选药品是
A. 他莫昔芬
B. 托瑞米芬
C. 氟他胺
D. 己烯雌酚
E. 甲羟孕酮

正确答案：C。氟他胺

解析：本题考查氟他胺。抗雄激素类药的代表药为氟他胺（C对），适用于晚期前列腺癌患者。他莫昔芬（A错）为抗雌激素类抗肿瘤药，用于治疗晚期乳腺癌和卵巢癌。托瑞米芬（B错）结构与他莫昔芬相似，类雌激素样作用比他莫昔芬弱。己烯雌酚（D错）是人工合成的非甾体雌激素物质，主要用于雌激素低下症及激素平衡失调引起的功能性出血、闭经，还可用于死胎引产前，以提高子宫肌层对催产素的敏感性。甲羟孕酮（E错）为孕激素类抗肿瘤药，主要用于乳腺癌、子宫内膜癌、前列腺癌、肾癌，也可用于改善晚期肿瘤患者的恶病质。